脂质体的制备方法不包括
A. 注入法
B. 薄膜分散法
C. 复凝聚法
D. 逆相蒸发法
E. 冷冻干燥法

正确答案：C。复凝聚法